下列缓解儿童感冒症状的方法中，不推荐的是
A. ≥6月龄儿童，可使用布洛芬或对乙酰氨基酚退热
B. 2岁及以上儿童，可睡前在胸部和颈部涂抹含薄荷脑的软膏，缓解鼻塞症状
C. 使用生理盐水冲洗鼻腔，缓解鼻分泌物增多和鼻塞症状
D. 布洛芬与对乙酰氨基酚交替使用，减轻发热引起的不适
E. 1岁及以上儿童睡前服用蜂蜜，减轻咳嗽症状

正确答案：D。布洛芬与对乙酰氨基酚交替使用，减轻发热引起的不适

解析：本题考查儿童感冒的药物治疗。治疗儿童感冒症状安全而有效的药物与成人不同。有效的药物包括解热镇痛药、鼻腔盐水冲洗、蜂蜜以及含樟脑、薄荷脑和桉树油的软膏。布洛芬和对乙酰氨基酚可减轻发热所致的不适（A对）。不推荐对乙酰氨基酚联合布洛芬用于儿童退热，也不推荐对乙酰氨基酚与布洛芬交替用于儿童退热（D错，为本题正确答案）。每天使用6次生理盐水冲洗鼻腔的儿童，鼻分泌物增多和鼻塞症状的缓解速度更快（C对）。2岁及2岁以上儿童睡前可在胸部和颈部涂抹含樟脑、薄荷脑和桉树油的软膏，可以缓解鼻塞（B对），降低夜间咳嗽的频率和严重程度。睡前服用蜂蜜也可以减少咳嗽的频率和严重程度（E对）。